盐酸氯丙嗪和奋乃静均需检查溶液的颜色，此项目检查的杂质是
A. 因被氧化而产生的杂质
B. 因被还原而产生的杂质
C. 因聚合而产生的杂质
D. 重金属
E. 铁盐

正确答案：A。因被氧化而产生的杂质